腹主动脉的直接分支，不包括
A. 腰动脉
B. 肾动脉
C. 肠系膜下动脉
D. 肾上腺中动脉
E. 脾动脉

正确答案：E。脾动脉

解析：腰动脉（A对）为腹主动脉的壁支。肾动脉（B对）、肠系膜下动脉（C对）、肾上腺中动脉（D对）为腹主动脉的脏支。脾动脉（E错，为本题正确答案）为腹腔干的直接分支。